安定和苯巴比妥的共同作用有
A. 抗焦虑
B. 抗惊厥
C. 抗癫痫
D. 抗休克
E. 镇静、催眠

正确答案：A、B、C、E。抗焦虑；抗惊厥；抗癫痫；镇静、催眠

解析：本题考查镇静催眠药。安定和苯巴比妥的共同作用有抗焦虑（A对）、抗惊厥（B对）、抗癫痫（C对）、镇静、催眠（E对）。镇静催眠药有巴比妥类和苯二氮䓬类，安定（地西泮）为苯二氮䓬代表药，小剂量即可产生抗焦虑作用；苯巴比妥大剂量才产生抗焦虑作用；安定具有较强的抗惊厥和抗癫痫作用，是癫痫持续状态首选药；苯巴比妥对癫痫大发作及其持续状态有较好疗效，在大于催眠剂量时有抗惊厥作用。二者均不用于抗休克治疗。